导致慢性肺心病最常见的疾病是
A. 支气管扩张
B. 慢性阻塞性肺疾病
C. 严重胸廓畸形
D. 支气管哮喘
E. 肺血栓栓塞症

正确答案：B。慢性阻塞性肺疾病

解析：慢性阻塞性肺疾病（COPD）是导致慢性肺心病最常见的疾病，约占肺心病病因的80%～90%（B对），COPD时，机体缺氧和二氧化碳潴留，使肺血管收缩、痉挛，其中缺氧是最重要的因素，此时收缩血管的活性物质增多，肺血管收缩，血管阻力增加，肺动脉高压形成，导致慢性肺心病。支气管扩张（A错）、严重胸廓畸形（C错）、支气管哮喘（D错）都可以导致慢性肺心病，但不是最常见的。肺血栓栓塞症常引起急性肺心病，而不是慢性肺心病（E错）。